控制长链脂肪酰基进入线粒体氧化的关键因素是
A. ATP水平
B. 肉碱脂酰转移酶的活性
C. 脂酰CoA合成酶的活性
D. 脂酰CoA的水平
E. 脂酰CoA脱氢酶的活性

正确答案：B。肉碱脂酰转移酶的活性